下列关于羊水的叙述，正确的是
A. 妊娠中期主要来自胎盘
B. 母体与羊水的交换主要通过脐带
C. 胎儿的吞咽可以使羊水量趋于平衡
D. 早期羊水主要来自胎儿尿液
E. 妊娠晚期胎儿的肝脏参与羊水的生成

正确答案：C。胎儿的吞咽可以使羊水量趋于平衡

解析：妊娠早期羊水主要来自母体血清经胎膜进入羊膜腔的透析液（D错）；妊娠中期以后，羊水的主要来源是胎儿尿液（A错）；妊娠晚期胎儿肺参与羊水的生成（E错）。母体与羊水的交换主要通过胎膜，每小时400ml（B错）；胎儿吞咽羊水，足月妊娠胎儿每日可吞咽羊水500～700ml，以使羊水量趋于平衡（C对）。